烟草的使用是导致人们患病和早逝的原因之一，烟草对人的危害可以有
A. 增加了心血管疾病的发病机会
B. 导致肺癌、慢性阻塞性肺病
C. 与口腔、喉、食管的肿瘤发生相关
D. 对胎儿、青少年的发育生长的影响
E. 以上都正确

正确答案：E。以上都正确